修复体粘固剂溶解引发了过敏性疼痛，最好的处理方法是
A. 观察
B. 降低咬合
C. 补充粘固剂
D. 拆除重新修复
E. 行根管治疗术

正确答案：D。拆除重新修复

解析：本题考查修复体戴入后的问题及处理。粘固剂溶解者，最好拆除重新修复（D对）。